关于牙髓组织不正确的是
A. 是疏松的结缔组织
B. 血管和神经非常丰富
C. 牙髓神经有定位能力
D. 有增龄性变化
E. 随年龄的增长细胞成分减少

正确答案：C。牙髓神经有定位能力

解析：牙髓内的神经大多数是有髓神经，传导痛觉；少数为无髓神经（交感神经），可调节血管的收缩和舒张，但是牙髓神经没有定位感受器，故牙髓神经疼痛无法进行定位。掌握“牙髓”知识点。